一定时间内，某病现有感染者人数所占的比例
A. 患病率
B. 病死率
C. 续发率
D. 死亡率
E. 感染率

正确答案：E。感染率

解析：感染率指在某个时间内被检查的人群中，某病现有感染者人数所占的比例。掌握“流行病学资料与疾病分布”知识点。